女，28岁。进行性背痛半年，下肢乏力，食欲减退。查体：T37.8℃，P90次/分，R18次/分，BP100/60mmHg，未见皮疹，双肺呼吸音清，未闻及干湿性啰音，心律齐，未闻及杂音，腹软，无肌紧张，移动性浊音阴性，胸椎后凸，有叩痛。X线片示：第6、7胸椎间隙变窄，椎旁软组织阴影增宽。实验室检查，血常规：Hb118g/L，WBC7.0×10⁹/L，L0.40，Plt112×10⁹/L，ESR60mm/h。最可能的诊断是
A. 胸椎结核
B. 胸椎转移癌
C. 化脓性脊柱炎
D. 胸椎间盘突出症
E. 胸椎血管瘤

正确答案：A。胸椎结核

解析：患者青年女性，进行性背痛半年，下肢乏力，食欲减退。T37.8℃（腋下正常温度36℃～37℃），BP100/60mmHg（正常值BP90～120/60～80mmHg），胸椎后凸，有叩痛。X线片示：第6、7胸椎间隙变窄，椎旁软组织阴影增宽（胸椎结核X线表现）。实验室检查，血常规：Hb118g/L，WBC7.0×10⁹/L，L0.40，Plt112×10⁹/L（正常100～300×10⁹/L），ESR60mm/h（正常女性＜20mm/h）。根据病史、症状、体征、实验室检查与影像学检查，最可能的诊断是胸椎结核（A对）。胸椎转移癌多见于老年人，疼痛逐日加重，X线平片可见骨破坏累及椎弓根，椎间隙高度正常（B错），一般无椎旁软组织块影。化脓性脊椎炎（C错）发病急，有高热及明显疼痛，进展很快，早期血培养可检出致病菌。X线表现进展快，其特征性X线表现可作鉴别。胸椎间盘突出症（D错）无全身症状，有下肢神经根受压症状，血沉不快。X线平片上无骨质破坏，CT、MRI检查可发现突出的髓核。